石棉肺患者的肺功能降低
A. 与X线胸片表现无关
B. 往往比X线胸片表现出现的早
C. 往往比X线胸片表现出现的晚
D. 与X线胸片表现同步
E. 与X线胸片表现相反

正确答案：B。往往比X线胸片表现出现的早